关于心静脉血的回流，正确的是
A. 经心最小静脉回流到冠状窦
B. 全部经冠状窦回流
C. 主要经心前静脉回流
D. 大部分静脉血经冠状窦回流
E. 直接回流到各个房室

正确答案：D。大部分静脉血经冠状窦回流

解析：大部分（D对B错）静脉血经冠状窦回流入右心房，亦有些小静脉可以直接注入心腔。